哪一项不是奥美拉唑的不良反应
A. 口干，恶心
B. 头晕，失眠
C. 胃黏膜出血
D. 外周神经炎
E. 男性乳房女性化

正确答案：C。胃黏膜出血

解析：奥美拉唑的不良反应发生率为较低，症状有头痛、头昏、失眠、外周神经炎等神经系统症状；在消化系统方面可见口干、恶心、呕吐、腹胀；其他可见男性乳腺发育、皮疹、溶血性贫血等。掌握“奥美拉唑”知识点。